因证候禁忌而不宜合用的药组是
A. 川贝枇杷露与天麻丸
B. 附子理中丸与参茸卫生丸
C. 七厘散与血府逐瘀丸
D. 当归补血汤与牵正散
E. 牛黄解毒片与附子理中丸

正确答案：E。牛黄解毒片与附子理中丸

解析：本题考查的是中成药之间的配伍禁忌。因证候禁忌而不宜合用的药组是牛黄解毒片与附子理中丸（E对）。不同功效药物联用的辨证论治和禁忌：附子理中丸与牛黄解毒片联用，附子理中丸系温中散寒之剂，适用于脾胃虚寒所致的胃脘痛、呕吐、腹泻等；而牛黄解毒片性质寒凉，为清热解毒泻火之剂，适用于火热毒邪炽盛于内而上扰清窍者，可见不加分析地盲目将两者合用是不适宜的。再如，盲目将附子理中丸与黄连上清丸、金匮肾气丸与牛黄解毒片等合用，均属不注意证候的不合理用药。川贝枇杷露与天麻丸（A错）因配伍禁忌不宜合用。含“十八反”“十九畏”药味中成药的配伍禁忌：现行版《中国药典》中有不宜同用药的规定，从不宜同用药的品种来看没有突破“十八反”和“十九畏”所含的品种。“十八反”“十九畏”中的药物，应属配伍禁忌，原则上是禁止联用。对于饮片处方，如果药味中含有“十八反”“十九畏”药物，那是比较容易发现的。但对于中成药，只有熟悉中成药制剂的处方内容，才有可能发现此类的配伍禁忌。例如，治疗风寒湿痹证的大活络丸、尪痹冲剂、天麻丸、人参再造丸等均含有附子，而止咳化痰的川贝枇杷露、蛇胆川贝液、通宣理肺丸等分别含有川贝、半夏，依据配伍禁忌原则，若将上述两组合用，附子、乌头与川贝、半夏当属相反禁忌同用之列。利胆中成药利胆排石片、胆乐胶囊、胆宁片等都含有郁金，若与六应丸、苏合香丸、妙济丸、纯阳正气丸、紫雪散等含丁香（母丁香）的中成药同时使用，就要注意具“十九畏”药物的禁忌。临床常用中成药心通口服液、内消瘰疬丸中含有海藻，祛痰止咳颗粒含有甘遂，若与橘红痰咳颗粒、通宣理肺丸、镇咳宁胶囊等含甘草的中成药联用也属禁忌之列。附子理中丸与参茸卫生丸（B错）、七厘散与血府逐瘀丸（C错）、当归补血汤与牵正散（D错）配伍的效果，2022年考试指南未明确说明。